以下涎腺肿瘤最易发生种植复发的肿瘤是
A. 肌上皮瘤
B. 多形性腺瘤
C. 腺淋巴瘤
D. 基底细胞腺瘤
E. 嗜酸细胞腺瘤

正确答案：B。多形性腺瘤

解析：本题考查多形性腺瘤。以下涎腺肿瘤最易发生种植复发的肿瘤是多形性腺瘤（B对）。多形性腺瘤虽为良性肿瘤，但包膜常不完整或有瘤细胞，包膜与瘤体黏着性差、易分离，易造成种植性复发。肌上皮瘤（A错）、腺淋巴瘤（C错）、基底细胞腺瘤（D错）、嗜酸细胞腺瘤（E错）均为良性肿瘤，手术彻底切除很少复发。